下列哪项与瘀血的形成无直接关系
A. 气滞
B. 血寒
C. 饮食偏嗜
D. 气虚
E. 血热

正确答案：C。饮食偏嗜

解析：血液的正常运行，主要与心、肺、肝、脾等脏的功能，气的推动与固摄作用，脉道的通利，以及寒热等内外环境因素密切相关。气为血之帅，血随气行，气滞则血瘀（A对）。血得热则行，得寒则凝，若外感寒邪，入于血脉，或阴寒内盛，血脉挛缩，则血液凝涩而运行不畅（B对）。气分阴阳，是推动和调控血液运行的动力，气虚则运血无力，无以充血则血脉不利，进而导致血液运行不畅（D对）。外感火热邪气，或体内阳盛化火，入舍于血，血热互结，煎灼血中津液，使血液黏稠而运行不畅（E对）。（C错，为本题正确答案）。